金属舌面板桩冠的适应证是
A. 根长度不足时
B. 牙体缺损大时
C. 深覆（牙合）及咬合紧时
D. 后牙桩
E. 尖牙桩

正确答案：C。深覆（牙合）及咬合紧时

解析：本题考查金属舌面板桩冠的适应证。深覆（牙合）及咬合紧时（C对），若使用普通桩核冠无法获得足够的牙体预备量，而使用金属舌面板桩冠，需要的牙体预备量少，符合要求。根长度不足时（A错），无法提供足够的固位和支持是不能行桩核冠修复的。牙体缺损大时（B错）只要满足桩核冠的条件进行普通桩核冠修复即可，无需进行金属舌面板桩冠修复。后牙桩（D错）需要承受较大咬合力，使用金属舌面板桩冠容易脱落，无法行使正常的咀嚼功能。金属舌面板桩冠的美观性略差，对于尖牙（E错）最好使用烤瓷或全瓷桩冠修复。